长松萝的药材特征是
A. 呈丝状，二叉状分枝，表面有明显的环状裂纹
B. 呈丝状，主轴单一，两侧有细短的侧枝密生，表面无环状裂纹
C. 茎方柱形，分枝对生，单叶对生，宽披针形，边缘有锯齿
D. 茎扁圆柱形，表面棕褐色，密被覆瓦状排列的肉质鳞片
E. 茎圆柱形，上部多分枝，叶互生，三回羽状深裂，小裂片矩圆形

正确答案：B。呈丝状，主轴单一，两侧有细短的侧枝密生，表面无环状裂纹

解析：本题考查的是长松萝的性状鉴别。长松萝的药材特征是呈丝状，主轴单一，两侧有细短的侧枝密生，表面无环状裂纹（B对）。松萝【性状鉴别】松萝地衣体长10～40cm，呈二叉状分枝，基部直径0.8～1.5mm。表面灰绿色或黄绿色，粗枝表面有明显的环状裂纹（A错）。质柔韧，略有弹性，不易折断，断面可见中央有线状强韧的中轴。气微，味酸。长松萝地衣体呈丝状，长可达1.3m，主轴单一，两侧侧枝密生，侧枝长0.3～1.5cm，似蜈蚣足状。均以身干、色灰绿、拉之有弹性、无杂质者为佳。